患者，男，45岁。心烦不寐，眩晕耳鸣健忘，腰痠梦遗，舌红少津，脉细数。其病变所在脏腑为
A. 心
B. 肾
C. 肝
D. 心、肾
E. 肝、胃

正确答案：D。心、肾

解析：心肾不交证是指心肾水火既济失调，心肾阴虚火旺所表现的证候。心烦不寐多因肾阴亏损，水不济火，不能上养心阴，心火偏亢，扰动心神所致；眩晕耳鸣健忘多因肾阴亏虚，骨髓失充，脑髓失养所致；腰痠多因腰膝失养所致；梦遗多因虚火内炽，相火妄动，扰动精室所致；舌红少津，脉细数均多因阴虚火旺所致。故其病变所在脏腑为心、肾（D对AB错）。肝的病变常见症状有精神抑郁，烦躁，胸胁、少腹胀痛，头晕目眩，巅顶痛，肢体震颤，手足抽搐，以及目疾，月经不调，睾丸疼痛等。非上述症状（C错）。肝胃不和证的辨证要点以脘胁胀痛、嗳气、吞酸、情绪抑郁等为主要表现。非上述症状（E错）。